患者，男，58岁，戴用全口义齿一月，固位良好，主诉讲话吐字不清，有时还有哨音，检查咬合关系正常，义齿磨光面光滑，可能的原因是
A. 义齿咬合不平衡
B. 上颌基托后缘伸展过长
C. 上颌前部基托过于光滑
D. 前牙覆（牙合）过大
E. 以上都有可能

正确答案：C。上颌前部基托过于光滑

解析：本题考查全口义齿戴用后可能出现的问题及原因。患者，男，58岁，戴用全口义齿一月，固位良好，主诉讲话吐字不清，有时还有哨音，检查咬合关系正常，义齿磨光面光滑，患者出现发音障碍和哨音可能的原因是上颌前部基托过于光滑（C对）。哨音产生的原因：1.基托前部腭面、前牙舌面过于光滑；2.后部牙弓狭窄，舌活动受阻，舌背、腭面间形成很小的空气排溢通道；3.下前牙排列过于舌倾（D错）。义齿咬合不平衡（A错）会导致黏膜疼痛溃疡、义齿松动等问题。上颌基托后缘伸展过长（B错）容易妨碍周围组织和系带的功能活动，导致局部红肿、溃疡和疼痛。